患儿，1岁。发热1天，全身见散在细小淡红色皮疹，喷嚏，流涕，偶有咳嗽，精神不振，胃纳欠佳，耳后臖核肿大，咽红，舌苔薄白。其诊断是
A. 麻疹
B. 奶麻
C. 风疹
D. 丹痧
E. 水痘

正确答案：C。风疹

解析：本题考察风疹、麻疹、奶麻(幼儿急疹)、丹痧（猩红热）的鉴别诊断，风疹诊断要点是发热，咳嗽，流涕，耳后、枕部臖核肿大有压痛，其次是发热当天到l天出疹（C对）。麻疹的辩证要点是发热，咳嗽，流涕，泪水汪汪，发热3~4天出诊，出疹时发热更高，口腔两颊近臼齿处可见麻疹黏膜斑（A错）。奶麻的辩证要点是突然高热，发热3~4出疹，热退疹出。（B错）。丹痧也称烂喉痧、烂喉丹痧、疫疹、疫痧，辩证要点是发热、咽喉肿痛或伴腐烂，发热数小时到一天出疹，出疹时高热，环口苍白圈，草莓舌，帕氏线。全身布有弥漫性猩红色皮疹，疹后脱屑脱皮为特征（D错）。水痘的主要特征是皮肤黏膜分批出现瘙痒性皮疹，丘疹、疱疹、结痂同时存在。（E错）。